气血两虚证的舌象是
A. 舌体淡痩
B. 舌淡齿痕
C. 舌尖芒刺
D. 舌暗瘀点
E. 舌红裂纹

正确答案：A。舌体淡痩

解析：气血两虚，气血阴液不足，不能充盈舌体，舌失濡养，故舌体瘦，气血亏虚，血不荣舌，故舌色淡。舌体淡瘦为气血两虚证的舌象（A对）。舌淡有齿痕为脾阳虚衰，水湿内停的舌象，阳虚运血无力，不能载血上充舌质，故舌淡，脾阳虚衰，津液输布障碍，水湿之邪停于体内，故舌体胖大，于舌内易成齿痕（B错）。舌尖芒刺为心火亢盛之象，舌尖为心之象，心火亢盛，热邪充斥舌络所致（C错）。舌暗瘀点为气滞血瘀之象（D错）。舌红裂纹为热盛伤津，邪热内盛，阴液大伤，或阴虚液损，使舌体失于濡润，舌面萎缩所致（E错）。